关于土壤气相，错误的是
A. 土壤中的空气组成成分在土壤上层与大气相近似
B. 深层土壤中O₂减少，CO₂增多
C. 土壤空气和大气之间经常进行气体交换
D. 土壤中空气各种成分的数量与污染程度无关
E. 土壤通气性与大气压力有关

正确答案：D。土壤中空气各种成分的数量与污染程度无关

解析：本题考查土壤气相。土壤气相是指土壤孔隙所存在的多种气体的混合物。土壤空气是指土壤孔隙中的气体。这些气体主要来自大气，其次为土壤中的生物化学过程所产生的气体。土壤空气的成分在上层与大气相近似（A对），而深层土壤空气中氧气逐渐减少，二氧化碳增加（B对），这主要是由于生物呼吸和有机物分解所致。土壤空气中还可含有氨、甲烷、氢、一氧化碳和硫化氢等有害气体。土壤空气成分的变化受土壤污染程度（D错，为本题正确答案）、土壤生物化学作用和与大气交换程度（C对）等因素的影响。土壤通气性还与大气压力有关（E对）。